蛋白质和多肽类药物的吸收机制是
A. 膜孔滤过
B. 简单扩散
C. 膜动转运
D. 易化扩散
E. 主动转运

正确答案：C。膜动转运

解析：本题考查药物的转运方式。蛋白质和多肽类药物的吸收机制是膜动转运（C对）。膜动转运是指生物膜通过主动变形，膜凹陷吞没将某些物质摄入细胞内或从细胞内释放到细胞外；膜孔滤过（A错）是指水溶性分子借助于流体静压或渗透压随体液通过细胞膜的水性通道而进行的跨膜转运；简单扩散（B错）是指脂溶性药物顺浓度差通过细胞膜；易化扩散（D错）是借助载体的被动转运；主动转运（E错）是借助载体或酶促系统，逆浓度梯度转运的过程。